温热病后，神倦瘈疭，舌绛少苔，脉虚弱者，治疗应选用
A. 羚角钩藤汤
B. 天麻钩藤饮
C. 地黄饮子
D. 大定风珠
E. 镇肝熄风汤

正确答案：D。大定风珠

解析：肝为风木之脏，阴液大亏，水不涵木，虚风内动，故而见手足瘈疭；真阴欲竭，故见神倦乏力、舌绛少苔、脉弱有时时欲脱之势。本证邪热已去八九，真阴仅存一二，治宜味厚滋补之品，滋阴养液，填补欲竭之真阴，平息内动之虚风。故用大定风珠滋阴息风（D对）。羚角钩藤汤（A错）的功用为凉肝息风，增液舒筋，主治肝热生风证。天麻钩藤饮（B错）的功用为平肝息风，清热活血，补益肝肾，主治肝阳偏亢，肝风上扰证。地黄饮子（C错）的功用为滋肾阴，补肾阳，开窍化痰，主治喑痱。大定风珠（D错）的功用为滋阴息风，主治阴虚风动证。镇肝熄风汤（E错）的功用为镇肝息风，滋阴潜阳，主治类中风。